在一定期间内，某人群中总死亡人数在该人群中所占的比例
A. 发病率
B. 死亡率
C. 罹患率
D. 病死率
E. 患病率

正确答案：B。死亡率